治疗慢性牙龈炎首选方法是
A. 龈下刮治术
B. 龈上洁治术
C. 全身药物治疗
D. 牙周手术
E. 松牙固定术

正确答案：B。龈上洁治术

解析：本题考查慢性龈炎。洁治术：牙菌斑和牙石是牙周病最主要的局部刺激因素，洁治术（B对）是去除龈上菌斑和牙石的最有效方法。龈上洁治术是指用洁治器械去除龈上牙石、菌斑和色渍，并磨光牙面，以延迟菌斑和牙石再沉积。